男，19岁。反复镜下血尿2年。无水肿、高血压。尿沉渣镜检红细胞10～20/HP。变形红细胞为主，蛋白尿阴性，血肌酐70μmol/L。临床应诊断为
A. 无症状性血尿
B. IgA肾病
C. 慢性肾小球肾炎
D. 泌尿系统肿瘤
E. 急性肾小球肾炎

正确答案：A。无症状性血尿

解析：患者青年男性，反复镜下血尿2年。无水肿、高血压（无症状性血尿临床表现）。尿沉渣镜检红细胞10～20/HP（正常＜3个/HP）。变形红细胞为主，蛋白尿阴性，血肌酐70μmol/L（正常76～88μmol/L）。根据病史、临床表现、辅助检查，最可能的诊断为无症状性血尿（A对）（P477）。IgA肾病（B错）（P469）可包含原发性肾小球疾病的各种临床表现，血尿最常见。慢性肾小球肾炎（C错）（P478）系指蛋白尿、血尿、高血压、水肿为基本临床表现，起病方式各有不同，病情迁延，病变缓慢进展，可有不同程度的肾功能减退，最终发展为慢性肾衰竭的一组肾小球疾病。急性肾小球肾炎（E错）（P466）是以急性肾炎综合征为主要临床表现的一组疾病。其特点为急性起病，患者出现血尿、蛋白尿、水肿和高血压，并可伴有一过性肾功能不全。多见于链球菌感染后，而其他细菌、病毒及寄生虫感染亦可引起。